中年以上男性持续或间断咳血痰或少量咯血，最大可能是
A. 肺炎
B. 肺脓肿
C. 肺气肿
D. 肺癌
E. 肺梗死

正确答案：D。肺癌

解析：肺癌多发于中年，男性多于女性，可有咳嗽，痰血或咯血，气短胸痛等（D对）。肺炎一般表现为发热咳嗽，咳痰，可有脓性痰或血痰（A错）。肺脓肿一般表现为高热，咳嗽，大量脓臭痰（B错）。肺气肿一般表现早期无症状或稍一活动出现呼吸急促（C错）。肺梗死是肺栓塞后因血流阻断而引起的肺组织坏死，引起肺栓塞的常见栓子是深静脉血栓。临床表现为胸闷、气短、呼吸困难、胸痛、低热、咳血。它发病突然，来势凶猛，病情危重，死亡率高（E错）。